通过抑制血管紧张素转化酶而降低血压的药物是
A. 缬沙坦
B. 氨氯地平
C. 依那普利
D. 可乐定
E. 二氮嗪

正确答案：C。依那普利

解析：本题考查依那普利。依那普利（C对）属于血管紧张素转换酶抑制剂（ACEI），其降压作用为抑制血管紧张素I转换成血管紧张素Ⅱ，同时还抑制缓激肽降解，从而扩张血管，降低血压。缬沙坦（A错）属于血管紧张素Ⅱ受体阻断剂。氨氯地平（B错）属于选择性钙通道阻滞剂。可乐定（D错）为中枢性α₂受体激动剂。二氮嗪（E错）为苯噻嗪类速效降压药，直接作用于血管平滑肌。